患者，男性，35岁。20天前因地震砸伤致右股骨干骨折，经内固定手术治疗，2小时前突然出现呼吸困难，胸痛伴咯血。查体：BP120/70mmHg，颈静脉无怒张，肝颈征阴性，A2P2。CTPA：肺栓塞。UCG及血流动力学监测示：右室运动功能正常。最适当的治疗是
A. 溶栓治疗
B. 抗凝治疗
C. 糖皮质激素
D. 抗生素和支气管舒张药
E. 强心利尿

正确答案：B。抗凝治疗

解析：根据病史该患者诊断为肺栓塞。肺栓塞的次大面积栓塞，在患者无右心功能不全表现时，不主张溶栓治疗，可考虑抗凝治疗。故该题选B。掌握“肺血栓栓塞症”知识点。